踝关节最不稳定的位置是
A. 足跖屈
B. 足背屈
C. 足外翻
D. 足内翻
E. 无

正确答案：A。足跖屈

解析：当踝关节跖屈时，较窄的滑车后部进入关节窝内，足能作轻微的侧方运动，关节不够稳定，易扭伤。踝关节最不稳定的位置是足跖屈（A对）。